关于股动脉的叙述，不正确的是
A. 是髂外动脉的直接延续
B. 出收肌管后延续为腘动脉
C. 近侧段浅面被肌肉覆盖
D. 近侧段外侧有股神经伴行
E. 内侧有股静脉伴行

正确答案：C。近侧段浅面被肌肉覆盖

解析：股动脉是髂外动脉的直接延续（A对）。出收肌管后延续为腘动脉（B对）。近侧段浅面被皮肤（C错，为本题正确答案）覆盖。近侧段外侧有股神经伴行（D对）。内侧有股静脉伴行（E对）。